具有截疟作用的中药是
A. 使君子、南瓜子
B. 常山、青蒿
C. 百部、白及
D. 鸦胆子、大蒜
E. 丹参、苦参

正确答案：B。常山、青蒿

解析：常山性味苦辛、寒，归肺、肝、心经，具有涌吐痰涎，截疟的功效；青蒿性味苦辛、寒，归肝、胆经，具有清虚热，除骨蒸，解暑热，截疟，退黄的功效；两味药皆有截疟的功效（B对）。使君子、南瓜子为驱虫药，具有杀虫、消积作用（A错）。百部有润肺下气止咳、杀虫灭虱之效；白及功效为收敛止血、消肿生肌（C错）。鸦胆子功效为清热解毒，止痢，截症，外用腐蚀赘症；大蒜功效为解毒消肿，杀虫，止痢（D错）。丹参功效为活血祛瘀、通经止痛、清心除烦、凉血消痈；苦参功效为清热燥湿、杀虫止痒、利尿（E错）。